下列属于循证决策的影响因素的是
A. 证据
B. 现有资源
C. 价值取向
D. A＋B＋C
E. A＋B

正确答案：D。A＋B＋C

解析：本题考查循证决策的影响因素。影响循证决策的三要素是：研究证据、可用资源和价值取向（D对ABCE错）。